与脑脊液循环无关的结构是
A. 蛛网膜粒
B. 第四脑室脉络丛
C. 第三脑室脉络丛
D. 海绵窦
E. 无

正确答案：D。海绵窦

解析：脑脊液循环主要有以下几个环节：脑脊液主要由脑室脉络丛产生，少量由室管膜上皮和毛细血管产生。侧脑室脉络丛产生的脑脊液经室间孔流至第三脑室，与第三脑室脉络丛（C对）产生的脑脊液一起，流入第四脑室，再汇合第四脑室脉络丛（B对）产生的脑脊液一起，经蛛网膜下隙，经蛛网膜粒（A对）渗透到硬脑膜窦内。海绵窦（D错，为本题正确答案）与脑脊液循环无关。